“阴阳之根本”是指
A. 肾
B. 脾
C. 胃
D. 肝
E. 肺

正确答案：A。肾

解析：本题考查阴阳之根本所对应的脏腑，属于理解记忆内容。肾气所分的肾阴、肾阳为机体生命活动的根本，肾阴肾阳又称‘五脏阴阳之本’（A对）。